可能引起足踝部水肿的药物是
A. 多沙唑嗪
B. 赖诺普利
C. 羟考酮
D. 辛伐他汀
E. 氨氯地平

正确答案：E。氨氯地平

解析：本题考查药物的不良反应。可能引起足踝部水肿的药物是氨氯地平（E对）。二氢吡啶类钙通道阻滞剂（氨氯地平）常见不良反应包括：反射性交感神经激活导致心跳加快、面部潮红、脚踝部水肿、牙龈增生等。多沙唑嗪（A错）为α肾上腺素能受体阻断剂，主要的不良反应为直立性低血压（伴高血压的老年患者易出现）、眩晕、头痛、乏力、困倦、逆向射精等。赖诺普利（B错）为血管紧张素转换酶抑制剂，最常见不良反应为干咳，其他不良反应有低血压、皮疹，血管神经性水肿，长期应用有可能导致血钾升高。羟考酮（C错）是强效镇痛药，可引起便秘、恶心、呕吐、头晕等不良反应。辛伐他汀（D错）属于他汀类的调血脂药，典型的不良反应是横纹肌溶解症。